在下列各项中能反映医学本质特征的是
A. 人才
B. 技术
C. 设备
D. 管理
E. 道德

正确答案：E。道德

解析：“医乃仁术”仁爱之心是医学人道主义精神的实质，是实现医学目的的前提和根本，是医德的真正意义所在。医学道德（E对）是医学的本质特征。